疗效高，生效快，控制疟疾临床发作首选
A. 氯喹
B. 奎宁
C. 伯氨喹
D. 乙胺嘧啶
E. 甲氟喹

正确答案：A。氯喹

解析：氯喹口服吸收快而完全，对各种疟原虫的红细胞内期裂殖体均有较强的杀灭作用，能迅速有效地控制疟疾的临床发作。掌握“氯喹、青蒿素、伯氨喹及乙胺嘧啶”知识点。